所谓“气之主”是指
A. 心
B. 肝
C. 脾
D. 肺
E. 肾

正确答案：D。肺

解析：本题考查的是肺与肾的关系。所谓“气之主”是指肺（D对）。肺与肾的关系：肺与肾的关系主要表现于津液代谢、呼吸运动、阴液互滋两个方面。1.津液代谢：肾为主水之脏，具有气化功能，升清降浊，主持水液的蒸腾气化，维持津液代谢的正常。肺为水之上源，具有宣发肃降功能，能使水道通调，可使上焦之水液下输于肾，浊者变为尿液排出体外。2.呼吸运动：肺主呼吸，肾主纳气，肺的呼吸功能需要肾的纳气作用来协助。肺从自然界吸入的清气，须在肺气肃降的作用下，下归于肾，由肾摄纳，才能为人体所用。若肾中精气充盛，摄纳功能正常，则可见呼吸深沉平稳。故有“肺为气之主，肾（E错）为气之根”之说。3.阴液互滋：肺肾之阴液亦相互资生，肾阴为一身阴液之根本，对各脏腑之阴液具有滋养作用。肺阴虚可损及肾阴，反之，肾阴虚亦无以上滋肺阴，从而形成肺肾阴虚证。心（A错）的生理功能主要有两方面：一是主血脉，二是主神明。肝（B错）的生理功能主要有两方面：一是主疏泄，二是藏血。脾（C错）的生理功能主要有两方面：一是主运化，二是主统血。